可促进肠内钙吸收的是
A. 膳食纤维
B. 未被消化的脂肪酸
C. 植酸
D. 草酸
E. 乳糖

正确答案：E。乳糖